侧腭杆离开龈缘至少是
A. 6mm
B. 4～6mm
C. 15mm
D. 16mm
E. 17mm

正确答案：B。4～6mm

解析：本题考查大连接体的类型与要求。侧腭杆离开龈缘至少是4～6mm（B对）。侧腭杆：位于腭隆突的两侧，离开龈缘4～6mm，与牙弓并行，厚1～1.5mm，宽3～3.5mm。设在一侧或两侧（双杆）均可，用于连接前、后腭杆。